将重金属铅对小鼠灌胃染毒，剂量为25mg/kg体重，该剂量相当于铅在
A. 脑中的量
B. 骨中的量
C. 胃肠道中的量
D. 血中的量
E. 肾中的量

正确答案：C。胃肠道中的量